在Ⅰ型超敏反应中起负反馈调节作用的细胞是
A. 肥大细胞
B. 嗜酸性粒细胞
C. Th2细胞
D. 中性粒细胞
E. 嗜碱性粒细胞

正确答案：B。嗜酸性粒细胞